新生儿神经系统反射，下列哪项不正确
A. 觅食反射阳性
B. 吸吮反射阳性
C. 克氏征阳性
D. 拥抱反射阳性
E. 腹壁反射稳定

正确答案：E。腹壁反射稳定

解析：新生儿临床上常用的原始反射如下：①觅食反射（A对）②吸吮反射（B对）③握持反射④拥抱反射（D对），其中正常足月儿也可出现年长儿的病理性反射，如克氏征阳性（C对），而腹壁和提睾反射不稳定（E错，为本题正确答案）。